蟾酥在采收加工过程中忌用
A. 铁器
B. 瓷器
C. 竹器
D. 木器
E. 玻璃器皿

正确答案：A。铁器

解析：本题考查的是蟾酥的采收加工。蟾酥在采收加工过程中忌用铁器（A对）。蟾酥：【采收加工】多于夏、秋两季捕捉蟾蜍，洗净，挤取耳后腺及皮肤腺的白色浆液，加工，干燥。采收加工过程中忌用铁器，以免变黑。将浆液放入圆模型中晒干或低温干燥，即为团蟾酥；如涂于玻璃板或竹箬叶上晒干或低温干燥，即为片蟾酥。